一般食物的蛋白质换算系数为
A. 5.85
B. 6.05
C. 6.25
D. 6.45
E. 6

正确答案：C。6.25